关于软膏剂的表述，不正确的是
A. 软膏剂主要起保护、润滑和局部治疗作用
B. 对于某些药物，透皮吸收后能产生全身治疗作用
C. 软膏剂按分散系统分类可分为溶液型、混悬型和乳剂型
D. 软膏剂应具有适当的黏稠度且易于涂布
E. 混悬型软膏剂除另有规定外，不得检出＞180目的粒子

正确答案：E。混悬型软膏剂除另有规定外，不得检出＞180目的粒子